上肺部病变伴低热、乏力，经正规抗菌药物治疗后肺部病灶不吸收，最先考虑的是
A. 干酪性肺炎
B. 葡萄球菌肺炎
C. 革兰阴性杆菌肺炎
D. 急性肺脓肿
E. 肺癌

正确答案：A。干酪性肺炎

解析：患者上肺部病变伴低热，经正规抗菌药物治疗后肺部病灶不吸收，考虑可能为干酪性肺炎（P68）（A对），其为继发性活动性肺结核，一般抗菌治疗无效，病变多在肺尖或锁骨上下。葡萄球菌肺炎（P48）（B错）、革兰阴性杆菌肺炎（C错）、急性肺脓肿（P60）（D错）均为细菌感染引起的，抗菌药物治疗均有效，与患者病情不符。肺癌（E错）体温常在38℃以下，可伴阻塞性肺炎，经抗生素治疗后病灶多可吸收。